某男，56岁。口渴引饮，能食易饥，大便溏薄，精神不振，四肢乏力；舌淡，苔薄白而干，脉细弱无力。空腹血糖为10.2mmol/L，糖化血红蛋白为8%。根据辨证结果，宜采用的治法是
A. 健脾益气
B. 养阴润燥
C. 温阳滋肾
D. 益气养血
E. 滋养肾阴

正确答案：A。健脾益气

解析：本题考查脾消渴之胃气虚证的治法。宜选用的治法是健脾益气（A对）。消渴之脾胃气虚证【症状】口渴引饮，能食与便溏并见，或饮食减少，精神不振，四肢乏力。舌淡，苔薄白而干，脉细弱无力。【治法】健脾益气。消渴之阴虚燥热证【症状】烦渴引饮，消谷善饥，小便频数而多，尿浑而黄，形体消瘦。舌红，苔薄黄，脉滑数。【治法】养阴润燥（B错）。消渴之阴阳两虚证【症状】小便频数，甚则饮一溲一，咽干舌燥，面容憔悴，耳轮干枯，腰膝酸软，畏寒肢冷。舌淡，苔白少津，脉沉细无力。【治法】温阳滋肾（C错）。痛经之气血虚弱证【症状】经期或经后小腹隐痛喜按，或小腹空坠不适，月经量少，色淡，质清稀；面色无华，头晕心悸，神疲乏力。舌淡，脉细无力。【治法】益气养血（D错），调经止痛。消渴之肾阴亏虚证【症状】尿频量多，浊如膏脂，腰酸膝软，头晕耳鸣，多梦遗精，乏力，皮肤干燥。舌红少苔，脉细数。【治法】滋养肾阴（E错）。